根据传染病防治法的规定，以下哪一项不属于医疗机构的职责
A. 传染病病例报告
B. 传染病医疗救治
C. 对拒绝隔离的患者采取强制措施
D. 防治医源性感染
E. 防止院内感染

正确答案：C。对拒绝隔离的患者采取强制措施

解析：根据传染病防治法的规定，医疗机构发现甲类传染病时，对拒绝隔离的患者，不属于医疗机构的职责，应由公安机关协助医疗机构对拒绝隔离的患者采取强制措施（C错，为本题正确答案）。医疗机构承担与医疗救治有关的传染病病例报告（A对）工作；传染病医疗救治（B对）工作；防治医源性感染（D对）工作；防止院内感染（E对）工作。